下列贫血性疾病中，属于大细胞性贫血的是
A. 再生障碍性贫血
B. 地中海贫血
C. 慢性病性贫血
D. 缺铁性贫血
E. 恶性贫血

正确答案：E。恶性贫血

解析：大细胞性贫血常见疾病：巨幼细胞贫血、伴网织红细胞大量增生的溶血性贫血、骨髓增生异常综合征、肝疾病，恶性贫血（E对）属于巨幼细胞贫血病因分类中的第2类吸收不良引起的巨幼细胞贫血。正常细胞性贫血常见疾病：再生障碍性贫血（A错）、纯红细胞再生障碍性贫血、溶血性贫血、骨髓病性贫血、急性失血性贫血。小细胞低色素性贫血常见疾病：缺铁性贫血（D错）、铁粒幼细胞贫血、珠蛋白生成障碍性贫血。珠蛋白生成障碍性贫血即地中海贫血（B错），9版内科学中仅述慢性病性贫血为造血调节因子水平异常所致贫血，未对其进行细胞学分类（C错）。